慢性支气管炎早期呼吸功能的最主要变化是
A. 大气道功能异常
B. 小气道功能异常
C. 大小气道、气流阻塞
D. 限制性通气功能障碍
E. 混合性通气功能障碍

正确答案：B。小气道功能异常

解析：慢性支气管炎早期，最先累及小支气管，如反映小气道的功能如闭合容积增大，一般反映大气道功能的检查如第一秒用力呼气容积、最大通气量、最大呼气中期流速多为正常。（八版病理学的观点）慢性支气管炎早期病变常限于较大的支气管，随病情进展逐步累及较小的支气管和细支气管。按照内科学观点，正确答案为B，按照病理学观点，正确答案为A，故此题并不严谨。限制性通气功能障碍（D错）多见于肺纤维化、胸腔积液和胸膜增厚。混合性通气功能障碍（E错）多见于慢阻肺。